关于一氧化碳中毒的叙述，下列何项不正确？
A. CO和Hb结合生成的碳氧血红蛋白无携氧能力
B. CO抑制RBC内糖酵解，使2，3-DPG减少，氧离曲线左移
C. 吸入气中CO浓度为0.1%时，约50%的Hb变成HbCO
D. 呼吸加深加快，肺通气量增加
E. 皮肤、粘膜呈樱桃红色

正确答案：D。呼吸加深加快，肺通气量增加

解析：一氧化碳可与血红蛋白结合形成碳氧血红蛋白（HbCO）使其失去携氧能力（A对），当HbCO增至50%时，皮肤、黏膜呈樱桃红色（E对）。CO与Hb的亲和力是氧的210倍，当吸入气中含有0.1%的CO时，约有50%的血红蛋白与之结合形成HbCO（C对）。同时CO还可抑制RBC内糖酵解，使2，3-DPG减少，氧离曲线左移（B对）。因为一氧化碳中毒时血氧分压正常，所以不会兴奋呼吸中枢引起呼吸加深加快，通气量增加（D错，为本题正确答案）。